在一级结构基础上形成蛋白质三级结构时可伴有
A. 构象改变
B. 亚基聚合
C. 肽键断裂
D. 二硫键形成
E. 蛋白质聚集

正确答案：D。二硫键形成